发生牙外伤最常见的原因是
A. 摔倒、碰撞
B. 交通意外
C. 运动损伤
D. 暴力
E. 把牙当工具

正确答案：A。摔倒、碰撞

解析：本题考查牙外伤的原因。发生牙外伤最常见的原因是摔倒、碰撞（A对）。牙外伤的原因：1.摔倒、碰撞：摔倒、碰撞以及物体撞击到牙是发生牙外伤最常见的原因。对于学龄前及学龄儿童，无意识牙外伤最常发生于家中及附近的地区。危险的周围环境和过度拥挤的环境，易使人摔倒，发生碰撞从而产生牙外伤。2.交通意外伤害（B错）：包括行走时被交通工具撞伤或骑自行车、驾驶汽车时发生意外，造成牙及颌面部的复合伤。15岁以下儿童由于骑自行车引起的面部外伤常伴有牙外伤。戴头盔骑车虽可降低面部及颅脑损伤的风险，但仍然有较高的牙外伤风险，因为头盔不能很好地保护面下部和下颌。3.运动损伤（C错）：体育运动是发生牙外伤的主要原因之一。受下列因素影响：运动的类型、运动场地、运动员的年龄和性别、运动的规模、体育竞赛水平、防护用具的使用、是否有教练和牙科医生提供指导等。4.暴力（D错）：也是导致牙外伤的危险因素。伊朗7～12岁儿童因暴力行为造成的牙外伤约占外伤的34%；印度12～15岁青少年因暴力行为造成的牙外伤约占3.4%。5.不良行为因素：很多人经常把牙当成是工具（E错），造成牙齿的损伤，例如，咬发卡、咬螺丝钉、用牙开启啤酒瓶盖或汽水瓶盖等。6.唇闭合不全和深覆盖：唇闭合不全与牙外伤密切相关。唇部对前牙有一定的保护作用，唇闭合不全的儿童更易发生前牙的外伤。覆盖超过3.5mm的儿童与覆盖正常的儿童相比，其发生牙外伤的风险明显增大。同时，有唇闭合不全和深覆盖的儿童，牙外伤的发生率更高。